抑制远曲小管管腔内上皮细胞对NaCl的重吸收
A. 乙酰唑胺
B. 安体舒通
C. 氨苯蝶啶
D. 氢氯噻嗪
E. 呋喃苯胺酸

正确答案：D。氢氯噻嗪

解析：本题考查利尿药。抑制远曲小管管腔内上皮细胞对NaCl的重吸收的是氢氯噻嗪（D对）。氢氯噻嗪的作用机制是抑制远曲小管近端Na⁺-Cl⁻共转运体，抑制NaCl的重吸收。乙酰唑胺（A错）为碳酸酐酶抑制剂，通过抑制碳酸酐酶的活性而抑制HCO₃⁻的重吸收。安体舒通（B错）即螺内酯，是醛固酮的竞争性拮抗剂，表现出排钠保钾的作用。氨苯蝶啶（C错）是肾小管上皮细胞Na⁺通道阻滞剂，产生排钠、利尿、保钾的作用。呋喃苯胺酸（E错）即呋塞米，为袢利尿药，干扰Na⁺-K⁺-2Cl⁻共同转运系统，产生强大的利尿作用。